47岁男性。上颌前牙固定修复3年，现出现松动，咬合疼痛。口腔检查：左上2缺失，左上123烤瓷固定桥修复，左上13为烤瓷全冠固位体，边缘均不密合。左上1远中和左上3的近中邻面可探及深龋，左上3叩诊（++），牙龈红肿，无牙周袋。余牙健康，咬合正常。治疗前最需做的辅助检查是基牙的X线检查。若左上3X线片示根尖有阴影，则引起咬合痛的可能原因是
A. 左上3急性牙髓炎
B. 左上3急性牙周炎
C. 左上3急性龈乳头炎
D. 左上3急性牙龈炎
E. 左上3急性根尖周炎

正确答案：E。左上3急性根尖周炎

解析：本题考查急性根尖周炎的临床表现。急性根尖周炎的临床表现为：咬合痛、松动、牙龈红肿等。慢性根尖周炎急性发作时，X线片上可见根尖部有不同程度的牙槽骨破坏所形成的的透影区。该患者左上3可探及深龋，并且有咬合痛及松动，牙龈红肿、X线片示根尖有阴影，符合急性根尖周炎的临床表现，故可诊断为左上3急性根尖周炎（E对）。急性牙髓炎、急性龈乳头炎和急性牙龈炎的患者根尖无病变，因此咬合痛的原因不是左上3急性牙髓炎（A错）、左上3急性龈乳头炎（C错）及左上3急性牙龈炎（D错）。急性牙周炎患者有牙周袋，该患者经检查，无牙周袋，因此引起咬合痛的原因不是左上3急性牙周炎（B错）。